某男，70岁，久患喘息，症见动则喘息加重，畏寒怕冷，证属下元虚冷，肾不纳气，当温肾纳气，宜选
A. 木香
B. 香附
C. 沉香
D. 佛手
E. 荔枝核

正确答案：C。沉香

解析：本题考查的是沉香的功效。久患喘息，症见动则喘息加重，畏寒怕冷，证属下元虚冷，肾不纳气，当温肾纳气，宜选沉香（C对）。沉香：【功效】行气止痛，温中止呕，温肾纳气。木香（A错）：【功效】行气止痛，健脾消食。香附（B错）：【功效】疏肝理气，调经止痛。佛手（D错）：【功效】疏肝理气，和中，化痰。荔枝核（E错）：【功效】行气散结，祛寒止痛。